为加强妇女保健工作，某大型企业组织全体女职工进行健康检查，采用快速的医学检查方法，从表面健康的女职工中查出乳腺癌和宫颈癌的可疑患者，再进一步确诊后给予早期治疗，这种疾病防治策略属于
A. 早期特异预防
B. 疾病的筛检
C. 高危人群的健康体检
D. 重点疾病的抽样调查
E. 一般健康促进

正确答案：B。疾病的筛检

解析：为加强妇女保健工作，某大型企业组织全体女职工进行健康检查，采用快速的医学检查方法，从表面健康的女职工中查出乳腺癌和宫颈癌的可疑患者，再进一步确诊后给予早期治疗，这种疾病防制策略属于疾病的筛检（B对），筛检是运用快速、简便的检验、检查或其他措施在健康人群中将那些可能有病或有缺陷但表面健康的人同那些真正无病的人区别开来。早期特异预防（A错）包括早发现、早诊断、早治疗。高危人群的健康体检（C错）是对高危人群进行体检，在体检报告出具后，总检医生将体检高危人群的检查相关项目的异常结果进行分级分类归档整理，是一项很有意义的工作。重点疾病的抽样调查（D错）是为了解某地区居民健康危害较为严重的疾病、慢性病、住院优势病种，以加强重点疾病的防治工作。一般健康促进（E错）是促进入们维护和提高自身健康的过程，是协调人与环境之间的战略，规定个人与社会对健康各自所负的责任。